充血性心力衰竭是指：
A. 心泵功能衰竭
B. 急性心力衰竭
C. 慢性心力衰竭
D. 以心脏扩大为特征的心力衰竭
E. 以血容量、组织间液增多为特征的心衰

正确答案：E。以血容量、组织间液增多为特征的心衰

解析：充血性心力衰竭时，由于心输出量不能与静脉回流相适应，故血液可在静脉系统中淤积．当心力衰竭呈慢性经过时，往往伴有血容量、组织间液增多（E对），并出现水肿。